关于小肠的说法，何者不对
A. 上端起自胃的幽门
B. 包括十二指肠、空肠、回肠三部分
C. 有肠脂垂、结肠带、结肠袋
D. 多属于腹膜内位器官
E. 管壁由粘膜、粘膜下组织、肌组织和外膜四层构成

正确答案：C。有肠脂垂、结肠带、结肠袋

解析：小肠上端起自胃的幽门(A对)，包括十二指肠、空肠、回肠三部分(B对)，肠脂垂、结肠袋、结肠带为结肠和盲肠的结构(C错，为本题正确答案)，十二指肠上部、空、回肠均为腹膜内位器官(D对)，小肠管壁由粘膜、粘膜下组织、肌组织和外膜四层构成(E对)。